由药物、食物、肠道寄生虫可引起荨麻疹的反应是
A. 皮肤过敏反应
B. 消化道过敏反应
C. 呼吸道过敏反应
D. 药物过敏性休克
E. 血清病

正确答案：A。皮肤过敏反应

解析：皮肤过敏反应　药物、食物、肠道寄生虫可引起荨麻疹和特应性皮炎（湿疹）。掌握“概述及Ⅰ型超敏反应”知识点。